中风闭证取
A. 中极、气海
B. 神阙、百会
C. 神阙、关元
D. 水沟、足三里
E. 水沟、十二井穴

正确答案：E。水沟、十二井穴

解析：中风基本病机是脏腑阴阳失调，气血逆乱，上扰清窍，窍闭神匿，神不导气。闭证治宜醒脑开窍启闭，结合中风取穴原则，闭证应选取水沟、十二井穴（E对）。脑为元神之府，督脉入络脑，水沟为督脉穴，用强刺激，以眼球湿润为度，可醒脑开窍；十二井穴用三棱针点刺出血，用于急救。